女，31岁。发热伴乏力牙龈出血1周，化验血Rt:Hb100g/L，白细胞：2.1X10⁹/L，骨髓细胞学检查：骨髓增生极度活跃，可见Auer小体，即MPO染色（+），PAS染色（-），NES染色（＋），且不被氟化钠抑制，流式细胞术免疫表型：CD34（-），CD33（+），最可能诊断为
A. AML-M5
B. AML-M6
C. AML-M4
D. AML-M2
E. AML-M3

正确答案：E。AML-M3

解析：患者为31岁女性，发热伴乏力牙龈出血1周，化验血Rt:Hb100g/L（女性正常值：110-150 g/L），白细胞：2.1X10⁹/L（正常值4-10x10⁹），骨髓细胞学检查：骨髓增生极度活跃，可见Auer小体，即MPO染色（+），PAS染色（-），NES染色（＋），且不被氟化钠抑制，流式细胞术免疫表型：CD34（-），CD33（+）。根据表6-9-1常见AL 的细胞化学鉴别可知，结合该患者骨髓细胞学检查中“MPO染色（+），NES染色（＋），且不被氟化钠抑制”可考虑该患者可能为急性粒细胞性白血病，再根据“骨髓细胞学检查中可见Auer小体，流式细胞术免疫表型：CD34（-），CD33（+）”可知白血病细胞中存在APL细胞（颗粒增多的早幼粒细胞为主，通常表达CD13 、CD33 和CD117），因此最有可能诊断为AML-M3（E对）。AML-M5（A错）为急性单核细胞白血病，其NES染色（＋），且氟化钠抑制≥50%。AML-M6（B错）为红白血病，不属于急性粒细胞性白血病。AML-M4（C错）为急性粒－单核细胞白血病，可存在一定程度的氟化钠抑制。AML-M2（D错）为急性粒细胞白血病部分分化型，分化程度较APL好，且可具有一定程度氟化钠抑制，相对而言应以AML-M3可能性更大。